男，33岁，15年前曾发现蛋白尿，一直未检查和治疗。三周前出现恶心呕吐，查：血压190/120mmHg，轻度浮肿，血肌酐360μmol/L，B超双肾缩小。下列检查项目中不应进行的是
A. 血常规
B. 内生肌酐清除率
C. 血电解质
D. 静脉肾盂造影
E. 心电图检查

正确答案：D。静脉肾盂造影

解析：青年男性患者，15年蛋白尿病史（提示肾功能受损），一直未检查和治疗。三周前出现恶心呕吐（伴发消化道症状，是慢性肾衰竭最早和最突出的症状），查：血压190/120mmHg（正常为90～130/60～90mmHg，提示有高血压），轻度浮肿（考虑为水、钠潴留引起），血肌酐360μmol/L（正常值88.4～176.8μmol/L，提示血肌酐升高），B超双肾缩小（慢性肾损伤的结果），其中蛋白尿、水肿、高血压，考虑有肾炎综合征。综合患者的病史、临床表现和实验室检查，考虑诊断为慢性肾衰竭。慢性肾衰竭患者肾小球硬化，肌酐清除率明显下降，需进行内生肌酐清除率（B对）检查了解肾脏功能，不宜进行静脉肾盂造影（D错，为本题正确答案）。因造影剂有一定的肾毒性，几乎全部从肾脏排泄，会加重肾脏损伤，且对病情诊断价值不大。慢性肾衰竭时常出现各种电解质代谢紊乱和酸碱平衡失调，病程中还会引起心血管病变（慢性肾衰竭患者的常见并发症和最主要死因）、肾性贫血和出血倾向、并发感染等，应做相应的检查以了解病情，如血电解质（C对）、心电图检查（E对）、血常规（A对）等。